用一种中性事物来替代一种忌讳的事物，可减少避免引起梦中自我的痛苦或创伤的是
A. 象征
B. 移置
C. 凝缩
D. 投射
E. 变形

正确答案：A。象征

解析：象征：即用一种中性事物来替代一种忌讳的事物，可减少避免引起梦中自我的痛苦或创伤。掌握“心理治疗原则、主要方法及应用”知识点。